细胞因子的特点不包括
A. 是一种信息物质
B. 由分化的内分泌腺所分泌
C. 作用于特定的靶细胞
D. 主要以旁分泌和自分泌方式发挥作用
E. 其化学本质是蛋白质或多肽

正确答案：B。由分化的内分泌腺所分泌